蔬菜在加工过程中不应该
A. 急火快炒
B. 加醋
C. 去除黄叶
D. 先切后洗
E. 现吃现炒

正确答案：D。先切后洗

解析：本题考查蔬菜的加工过程。蔬菜在加工过程中应去除黄叶（C对），先洗后切（D错，为本题正确答案），急火快炒（A对），现做现吃（E对），可以适量加醋（B对）。